患者，男性，65岁。高血压病史18年，近日有时夜间出现胸闷，并有频发的阵发性室上性心动过速，此时宜选用
A. 硝苯地平
B. 普萘洛尔
C. 普罗帕酮
D. 维拉帕米
E. 卡托普利

正确答案：D。维拉帕米